职业性有害因素是指
A. 生产工艺过程中存在的有害健康的各种职业因素
B. 劳动过程中所有能对健康产生不良影响的职业因素
C. 不良劳动条件下存在的能对健康产生不良影响的职业因素
D. 生产环境中存在的能对健康产生不良影响的职业因素
E. 以上都不是

正确答案：D。生产环境中存在的能对健康产生不良影响的职业因素

解析：本题考查职业性有害因素。职业性有害因素是指生产环境中存在的各种可能危害职业人群健康和影响劳动能力的不良因素（D对ABCE错）。